初孕妇，25岁。妊娠37周，剧烈头痛并呕吐，并自觉胎动少一天，血压BP160/110mmHg，尿蛋白（++），胎心130次/分，子宫颈管未消失，OCT呈频繁晚期减速（迟发性减速），血细胞比容0.41。最合适的处理是
A. 静滴硫酸镁及与胼苯哒嗪控制病情
B. 硫酸镁加降压加扩容疗法控制病情
C. 积极治疗，48小时未能控制病情则行剖宫产
D. 破膜加静滴缩宫素引产
E. 积极药物治疗的同时立即剖宫产

正确答案：E。积极药物治疗的同时立即剖宫产

解析：初孕妇妊娠37周，剧烈头痛并呕吐（重度子痫前期可有持续头痛或视觉障碍或其它脑神经症状），血压BP160/110mmHg（重度子痫前期收缩压≥160mmHg和（或）舒张压≥110mmH），尿蛋白（++），应诊断为重度子痫前期，妊娠37周后的重度子痫前期应终止妊娠。该孕妇自觉胎动少一天，OCT（缩宫素激惹试验）呈频繁晚期减速（迟发性减速），说明胎儿情况不佳，应立即终止妊娠。但该孕妇宫颈管未消退，短时间内不能经阴道分娩，故最合理的处理是积极药物治疗的同时立即剖宫产（E对C错）。硫酸镁静脉滴注（P71）可控制子痫抽搐及预防子痫前期发展为子痫；肼苯哒嗪（肼屈嗪）（八年制妇产科学第2版P83）为妊娠高血压疾病的常用药物，主要作用于血管舒缩中枢或直接作用于小动脉平滑肌，可快速降压，两者仅属于积极的药物治疗（AB错）。破膜加静滴缩宫素引产（P189）（D错）适用于协调性宫缩乏力，宫口扩张≥3cm、无头盆不称、胎头已衔接而产程缓慢者。